女，36岁，患风心病10年，近来心悸胸闷痛，气短，下肢浮肿，尿少，数分钟前突然晕倒，意识丧失，皮肤苍白，唇绀，大动脉搏动扪不到，呼吸停止，其原因是
A. 脑栓塞
B. 急性左心衰竭
C. 癫痫大发作
D. 心脏性猝死
E. 急性右心衰竭

正确答案：D。心脏性猝死

解析：患者为中年女性，有风心病病史10年，后出现心悸胸闷气短下肢浮肿尿少等症状数分钟前晕倒，意识丧失，符合心脏性猝死诊断中的神志丧失，后呼吸停止，大动脉搏动触及不到，符合心脏性猝死（D对）。